胆固醇在体内的主要生理功能是
A. 影响基因表达
B. 合成磷脂的前体
C. 控制胆汁分泌
D. 影响胆汁分泌
E. 控制膜的流动性

正确答案：E。控制膜的流动性